在防止矽尘的工艺过程中，能根本消除粉尘危害的是
A. 生产设备的技术革新
B. 远距离操作
C. 密闭发尘场所
D. 加强工人防护
E. 以无SiO₂物质代替含石英的材料

正确答案：A。生产设备的技术革新

解析：我国防尘的八字经验为：革、水.密、风、护、管、教、查。革：即改革工艺过程，革新生产设备（八年制预防医学第二版P97），是消除粉尘危害的根本途径（A对）。水：即湿式作业。密、风：即密闭、抽风、除尘，密闭尘源与局部抽风相结合，防止粉尘外逸，含尘空气在排出之前应先进行除尘处理。护：即个人防护。查：即健康检查。教：即加强宣传教育。管：即加强监督管理。密闭发尘场所、加强工人防护均是粉尘的预防措施，但不能根本消除粉尘危害（CD错）。远距离操作、以无SiO₂物质代替含石英的材料不是粉尘的预防措施（BE错），不能消除粉尘危害，故不选。